种植义齿修复原则包括
A. 坚固耐用
B. 恢复良好的美学效果
C. 具有良好的固位、支持
D. 有益于口腔软、硬组织健康
E. 以上说法均正确

正确答案：E。以上说法均正确

解析：种植义齿修复原则①恢复良好的功能；②恢复良好的美学效果；③具有良好的固位、支持和稳定；④有益于口腔软、硬组织健康；⑤坚固耐用。掌握“种植义齿的组成和修复治疗原则”知识点。